切除腺垂体后，其分泌受影响最小的激素是
A. 甲状旁腺激素
B. 生长激素
C. 糖皮质激索
D. 雌激素
E. 雄激素

正确答案：A。甲状旁腺激素

解析：生长激素本身在垂体前叶合成的释放；垂体可以调控肾上腺皮质分泌糖皮质激素；垂体也可调控相关性腺分泌雌激素，雄激素。